血浆胶体渗透压降低时可引起
A. 组织液减少
B. 组织液增多
C. 尿少
D. 红细胞萎缩
E. 红细胞膨胀和破裂

正确答案：B。组织液增多